葡萄球菌肺炎可见
A. 铁锈色痰
B. 粉红色泡沫痰
C. 砖红色胶冻状痰
D. 脓性痰
E. 粉红色乳状痰

正确答案：E。粉红色乳状痰

解析：葡萄球菌肺炎起病较急，寒战，高热（体温多高达39℃～40℃），胸痛，咳嗽，咯脓痰，痰带血丝或呈脓血状（E对）。咳铁锈色痰为肺炎链球菌肺炎的特征（A错）；肺水肿时咳粉红色稀薄泡沫痰（B错）；咳红棕色胶冻状痰提示克雷白杆菌感染（C错）；急性感染时为脓性痰（D错）。